对Igα/Igβ描述正确的是
A. 与mlg组成BCR复合物
B. 胞质区有ITAM
C. 可传导第一活化信号进入B细胞
D. 上列A和B两项
E. 上列A、B和C3项

正确答案：E。上列A、B和C3项